《中华人民共和国刑法》关于生产、销售伪劣商品罪规定，生产者、销售者在产品中掺杂、掺假、以次充好，销售金额在5万元以上不满20万元的
A. 处三年以下有期徒刑或者拘役，并处罚金
B. 处三年以上十年以下有期徒刑，并处罚金
C. 处十年以上有期徒刑、无期徒刑或者死刑，并处罚金
D. 处二年以下有期徒刑或者拘役，并处或单处罚金
E. 处二年以上七年以下有期徒刑并处罚金

正确答案：D。处二年以下有期徒刑或者拘役，并处或单处罚金

解析：本题考查生产、销售伪劣商品罪。《中华人民共和国刑法》关于生产、销售伪劣商品罪规定，生产者、销售者在产品中掺杂、掺假、以次充好，销售金额在5万元以上不满20万元的处二年以下有期徒刑或者拘役，并处或单处罚金（D对）。《中华人民共和国刑法》第三章破坏社会主义市场经济秩序罪第一节生产、销售伪劣商品罪第一百四十条：生产者、销售者在产品中掺杂、掺假，以假充真，以次充好或者以不合格产品冒充合格产品，销售金额五万元以上不满二十万元的，处二年以下有期徒刑或者拘役，并处或者单处销售金额百分之五十以上二倍以下罚金；销售金额二十万元以上不满五十万元的，处二年以上七年以下有期徒刑，并处销售金额百分之五十以上二倍以下罚金（E错）；销售金额五十万元以上不满二百万元的，处七年以上有期徒刑，并处销售金额百分之五十以上二倍以下罚金；销售金额二百万元以上的，处十五年有期徒刑或者无期徒刑，并处销售金额百分之五十以上二倍以下罚金或者没收财产。第一百四十一条：生产、销售假药的，处三年以下有期徒刑或者拘役，并处罚金（A错）；对人体健康造成严重危害或者有其他严重情节的，处三年以上十年以下有期徒刑，并处罚金（B错）；致人死亡或者有其他特别严重情节的，处十年以上有期徒刑、无期徒刑或者死刑，并处罚金或者没收财产（C错）。本条所称假药，是指依照《中华人民共和国药品管理法》的规定属于假药和按假药处理的药品、非药品。